不伴有胆囊肿大的是
A. 胆总管结石
B. 壶腹癌
C. 胰头癌
D. 胆囊炎
E. 肝门部肿瘤

正确答案：E。肝门部肿瘤

解析：肝门部肿瘤（E对）使胆汁受阻于肝门部，不会经胆囊管进入胆囊，因此胆囊无胆汁淤积，不伴有胆囊肿大。胆总管结石（A错）可阻塞胆总管下端，使胆汁排出受阻，胆汁逆流进入胆囊，引起胆囊肿大。壶腹癌（B错）、胰头癌（C错）均可阻塞胆总管与胰管组成的共同通道胆汁流出受阻，经胆囊管逆流进入胆囊，引起胆囊肿大。胆囊炎（D错）可引起胆囊肿大。